青蒿与地骨皮除均能退虚热外，又均能
A. 生津
B. 解暑
C. 利尿
D. 凉血
E. 清肺降火

正确答案：D。凉血

解析：本题考查的是青蒿、地骨皮的功效。青蒿与地骨皮除均能退虚热外，又均能凉血（D对）。青蒿：【功效】退虚热，凉血，解暑（B错），截疟。地骨皮：【功效】退虚热，凉血，清肺降火（E错），生津（A错）。白薇：【功效】退虚热，凉血清热，利尿（C错）通淋，解毒疗疮。